抗菌活性强，可产生前庭反应的药物是
A. 氯霉素
B. 多西环素
C. 土霉素
D. 四环素
E. 米诺霉素

正确答案：E。米诺霉素

解析：米诺环素处四环素共有的不良反应外，米诺还俗产生独特的前庭反应，出现恶心、呕吐、眩晕、运动失调等症状；首剂服药可迅速出现，女性多于男性，停药24~48小时后症状消失。掌握“四环素、多西环素及米诺环素”知识点。